知觉不具有的特征是
A. 整体性
B. 恒常性
C. 理解性
D. 倾向性
E. 选择性

正确答案：D。倾向性

解析：知觉的基本特性包括选择性（E对）、整体性（A对）、理解性（C对）、恒常性（B对）。因此，知觉不具有倾向性（D错，为本题正确答案）。